意志行动的核心是
A. 未运动
B. 随意运动
C. 非随意运动
D. 有目的的行动
E. 克服困难的行动

正确答案：E。克服困难的行动

解析：意志行动的核心是克服困难的行动。掌握“意志过程”知识点。